葡萄糖的鉴别方法是
A. 加水与0.4%氢氧化钠溶液使溶解，加硫酸铜试液1滴，即生成草绿色沉淀
B. 加水1ml溶解后，加硝酸5滴，即显红色，渐变为淡黄色
C. 加甲醛-硫酸试液1滴，即显紫堇色
D. 加硫酸1滴溶解后，加重铬酸钾的结晶1小粒，周围即显紫色
E. 加水5ml溶解后，缓缓滴入微温的碱性酒石酸铜试液中，即生成红色沉淀

正确答案：E。加水5ml溶解后，缓缓滴入微温的碱性酒石酸铜试液中，即生成红色沉淀

解析：本题考查常用的药品鉴别方法。葡萄糖的鉴别方法是加水5ml溶解后，缓缓滴入微温的碱性酒石酸铜试液中，即生成红色沉淀（E对）。葡萄糖的鉴别方法为：取供试品约0.2g，加水5ml溶解后，缓缓滴入微温的碱性酒石酸铜试液中，即生成氧化亚铜的红色沉淀。盐酸吗啡等异喹啉类生物碱的鉴别方法是将药物与甲醛-硫酸试液反应显紫堇色（C错）。